体位性低血压恢复正常时，心率加快的原因是
A. 心交感神经冲动增多
B. 交感缩血管纤维冲动增多
C. 心迷走神经冲动增多
D. 窦神经冲动增多
E. 交感舒血管纤维冲动增多

正确答案：A。心交感神经冲动增多

解析：体位性低血压指从卧位到坐位或直立位，或长时间站立引起的低血压，此时心血管压力感受性反射活动减弱，心交感神经和交感缩血管神经冲动增多，促使血压回升，心交感神经冲动增多（A对）引起心肌收缩力增强、心率加快和传导性增加，交感缩血管神经冲动增多（B错），引起血管收缩。心迷走神经冲动增多（C错）主要引起心房肌收缩力减弱、心率减慢和房室传导速度减慢（P132）。颈动脉窦压力感受器的传入神经纤维组成窦神经，动脉血压升高时，窦神经冲动增多（D错）使心交感紧张和交感缩血管紧张减弱、迷走神经紧张加强（P135），引起心率减慢、心输出量减少，外周阻力减小，动脉血压下降。交感舒血管神经纤维（E错）在情绪激动和发生防御反应时发放冲动，使骨骼肌血管舒张，血流量增多（P133）。